菊花的主治病证不包括
A. 燥咳痰黏
B. 温病初起
C. 热毒疮肿
D. 眼目昏花
E. 肝阳头痛

正确答案：A。燥咳痰黏

解析：本题考查的是菊花的主治病证。本菊花的主治病证不包括燥咳痰黏（A错，为本题正确选项）。菊花：【主治病证】（1）风热感冒，温病初起（B对）。（2）风热或肝火上攻所致的目赤肿痛。（3）肝阴虚之眼目昏花（D对）。（4）风热头痛，肝阳头痛（E对）、眩晕。（5）热毒疮肿（C对）。燥咳痰黏为天花粉的主治病证。天花粉：【主治病证】（1）热病伤津口渴，内热消渴。（2）肺热咳嗽，燥咳痰黏，咳痰带血。（3）痈肿疮疡，跌打肿痛。此外，制成天花粉蛋白注射液肌内注射又能引产。